《中华人民共和国大气污染防治法》的主要内容不包括
A. 污物无害化处理
B. 监督管理
C. 防治废气污染
D. 防治粉尘污染
E. 防治恶臭污染

正确答案：A。污物无害化处理